药用辅料是制剂生产中必不可少的重要组成部分，其主要作用不包括的是
A. 提高药物稳定性
B. 降低药物不良反应
C. 降低药物剂型设计难度
D. 提高用药顺应性
E. 调节药物作用速度

正确答案：C。降低药物剂型设计难度

解析：本题考查药用辅料的作用。药用辅料的作用包括：赋形、使制备过程顺利进行、提高药物稳定性（A对）、提高药物疗效、降低药物不良反应（B对）、调节药物作用。选用不同的辅料，可使制剂具有速释性、缓释性（E对），药用辅料还能提高病人用药的顺应性（D对）。并不能降低药物剂型设计难度（C错，为本题正确答案）